女婴，8个月。母乳喂养，未添加辅食。查体：面色苍白，肝脾肿大。外周血象：75g/L，RBC3.5×10¹²/L，MCV70fl，MCH26pg，MCHC30%。其贫血的细胞形态是
A. 单纯小细胞性贫血
B. 大细胞性贫血
C. 小细胞低色素性贫血
D. 正细胞正色素性贫血
E. 正细胞低色素性贫血

正确答案：C。小细胞低色素性贫血

解析：女婴患者，母乳喂养，未添加辅食。查体：面色苍白，肝脾肿大。外周血象：Hb75g/L（正常值新生儿170～200g/L），RBC3.5×10¹²/L（正常值儿童4.0～5.3×10¹²/L），MCV70fl（正常值80～94fl），MCH26pg（正常值26.0～34.0pg），MCHC30%（正常值32％～36％）。综合患者的症状、体征和辅助检查，其贫血的细胞形态是小细胞低色素性贫血（C对）。单纯小细胞性贫血（A错）的MCHC值为32％～36％。大细胞性贫血（B错）、正细胞正色素性贫血（D错）、正细胞低色素性贫血（E错）的MCV值分别为﹥94fl、80～94fl、80～94fl。